IgA肾病最常见的临床表现为
A. 蛋白尿
B. 白细胞尿
C. 血尿
D. 水肿
E. 高血压

正确答案：C。血尿

解析：IgA肾病临床表现可包含原发性肾小球疾病的各种临床表现如蛋白尿（A错）、水肿（D错）、高血压（E错），但血尿最常见（C对）。IgA肾病早期高血压（E错）并不常见（＜5%-10%），随着病程延长高血压发生率增高，部分IgA肾病患者可呈恶性高血压，为继发性肾实质恶性高血压的最常见病因之一（P469）。合并尿路感染时可以出现白细胞尿（B错），不是IgA最常见的症状。